化合物中酸性最弱的是
A. 5-羟基黄酮
B. 6-羟基黄酮
C. 7-羟基黄酮
D. 4'-羟基黄酮
E. 7，4'-二羟基黄酮

正确答案：A。5-羟基黄酮

解析：本题考查的是黄酮的酸性。化合物中酸性最弱的是5-羟基黄酮（A对）。黄酮的酸性：多数黄酮类化合物因分子中具有酚羟基，故显酸性，可溶于碱性水溶液、吡啶、甲酰胺及二甲基甲酰胺等有机溶剂中。由于酚羟基数目及位置不同，酸性强弱也不同。以黄酮为例，其酚羟基酸性强弱顺序依次为：7，4'-二羟基（E对）＞7-二羟基或4'-羟基（CD错）＞一般酚羟基（B错）＞5-羟基。